皮疹为全身皮肤弥漫性发红，广泛性密集均匀
A. 猩红热
B. 水痘
C. 麻疹
D. 幼儿急疹
E. 风疹

正确答案：A。猩红热

解析：猩红热的皮疹特点是皮肤弥漫性充血，上有密集针尖大小丘疹，全身皮肤均可受累，疹退后伴脱皮（A对）。水痘皮疹特点为皮肤黏膜相继出现和同时存在斑疹、丘疹、疱疹和结痂等各类皮疹（B错）。麻疹的皮疹特点是红色斑丘疹，自头面部→颈→躯干→四肢，退疹后有色素沉着及细小脱屑（C错）。幼儿急诊的皮疹特点是红色细小密集斑丘疹，头面颈及躯干部多见，四肢较少，一天出齐，次日即开始消退（D错）。风疹的皮疹特点是面颈部→躯干→四肢，斑丘疹，疹间有正常皮肤，退疹后无色素沉着及脱屑（E错）。